霍乱的主要致病因子是
A. 肠毒素
B. 内毒素
C. 类毒素
D. 细胞毒素
E. 神经毒素

正确答案：A。肠毒素

解析：霍乱肠毒素是引起霍乱患者腹泻的主要物质（A对）。此外。霍乱肠毒素能促使肠黏膜杯状细胞分泌黏液增多，使水样便中含大量黏液。剧烈腹泻导致失水，胆汁分泌减少，患者的粪便可呈“米泔水”样。